在进行临床试验设计时，允许犯第Ⅱ类错误的概率最大值是取
A. β=0.01
B. β=0.05
C. β=0.10
D. β=0.20
E. β=0.25

正确答案：D。β=0.20